乳酸循环所需的NADH主要来自
A. 三羧酸循环过程中产生的NADH
B. 脂肪酸β-氧化过程中产生的NADH
C. 糖酵解过程中3-磷酸甘油醛脱氢产生的NADH
D. 磷酸戊糖途径产生的NADPH经转氢生成的NADH
E. 谷氨酸脱氢产生的NADH

正确答案：C。糖酵解过程中3-磷酸甘油醛脱氢产生的NADH